下列关于小儿免疫系统的说法，错误的是
A. 新生儿B淋巴细胞发育已完善，但不成熟
B. 新生儿时期各种T细胞亚群功能均显不足
C. IgM不能通过胎盘
D. IgG不能通过胎盘
E. 脐血IgM水平过高，提示可能有宫中感染

正确答案：D。IgG不能通过胎盘

解析：IgG是唯一能通过胎盘的Ig（D错，为本题正确答案），故IgM不能通过胎盘（C对），脐血IgM水平过高，提示可能有宫中感染（E对）。新生儿B淋巴细胞发育已完善，但未受到抗原刺激尚未产生记忆细胞，故不成熟（A对）。新生儿非特异性和特异性免疫功能均不成熟，T细胞免疫功能低下（B对）是新生儿免疫应答无能的主要原因。